一年青人右侧外耳门附近受到重物的撞击，伤后出现右侧面肌瘫痪，并有血液和脑脊液经外耳门流出，其骨折部位最可能是
A. 颞骨鳞部骨折
B. 颞骨鼓部骨折并有鼓膜裂伤
C. 鼓室盖骨折并伴有鼓膜裂伤
D. 颞骨乳突部骨折
E. 颞骨颧突骨折

正确答案：C。鼓室盖骨折并伴有鼓膜裂伤

解析：颞骨岩部前面朝向颅中窝，中央有弓状隆起，隆起外侧较薄的部分，称鼓室盖，近尖端处有光滑的三叉神经压迹。若受重物撞击，鼓室盖骨折，可损坏三叉神经，导致面肌瘫痪，鼓膜裂伤，导致血液脑脊液经外耳门流出（C对）。